关于椎静脉丛的描述，哪项错误
A. 具有静脉瓣
B. 分布于脊柱周围
C. 分布于硬膜外隙
D. 与腰静脉相交通
E. 与肋间后静脉相交通

正确答案：A。具有静脉瓣

解析：椎内、外静脉丛无静脉瓣膜（A错，为本题正确答案）。椎外静脉丛分布于脊柱周围（B对）。椎内静脉丛分布于硬膜外隙（C对）。椎内、外静脉丛互相吻合，与附近的椎静脉、腰静脉（D对）、肋间后静脉（E对）和骶外侧静脉等相交通。